患者，女，51岁，体检时发现血160/105mmHg，量试验餐后2小时血糖为9.56mmol/L（参考范围＜7.8mmol/L），甘油三酯0.52mmol/L（参考范围0.56～1.70mmol/L），总胆固醇6.26mmol/L（参考范围＜0.2mmoL），低密度脂蛋白胆固醇4.85mmol/L（参考范围2.1～3.1mmol/L），高密度脂蛋白胆固醇1.20mmol/L（参考范围1.2～1.65mmol/L，肌酐60㎛ol/L（参考范围45～84㎛ol/M），蛋白尿：++。临床诊断为高血压病、高脂血症、糖耐量异常。该患者宜选用的抗高血压药是
A. 氢氯噻嗪
B. 复方利血平
C. 依那普利
D. 特拉唑嗪
E. 螺内酯

正确答案：C。依那普利

解析：本题考查抗血压药。依那普利（C对）为ACEI类药物，适用于伴慢性心力衰竭、心肌梗死后伴心功能不全、糖尿病肾病、非糖尿病肾病、代谢综合征、蛋白尿或微量白蛋白尿患者。